男，18岁。平素体健，因偶尔碰伤后流血不止，经检査为血友病甲型。则该患者缺乏的因子是
A. Ⅷ因子缺乏
B. Ⅸ因子缺乏
C. Ⅺ因子缺乏
D. Ⅶ因子缺乏
E. Ⅴ因子缺乏

正确答案：A。Ⅷ因子缺乏

解析：患者被诊断为血友病甲型，即血友病A，又称FⅧ缺乏症，故该患者缺乏的因子为Ⅷ因子（A对）。Ⅸ因子缺乏（P618）（B错）是血友病B缺乏的因子；Ⅺ因子缺乏（C错）是血友病C缺乏的因子；Ⅶ因子缺乏（D错）常见于严重的肝功能障碍、维生素K缺乏及遗传性Ⅶ因子缺乏症。Ⅴ因子缺乏（E错）常见于严重的肝功能障碍。